下列有关家族性矮身材的描述不正确的是
A. 个体身高低于其年龄标准的第3百分位数
B. 生长曲线和正常儿童平行
C. 不包括垂体性侏儒症等内分泌性生长障碍
D. 骨龄显著小于实足年龄
E. 能否实现理想成年身高和是否采取有效措施无关

正确答案：D。骨龄显著小于实足年龄